某女，18岁，一周前突发黄疸，症见面目悉黄，胸肋胀痛，恶心呕吐，小便黄赤，证属肝胆湿热，宜选用的成药是
A. 香连丸
B. 排石颗粒
C. 消炎利胆片
D. 沉香化滞丸
E. 茵栀黄口服液

正确答案：E。茵栀黄口服液

解析：本题考查的是茵栀黄口服液的主治。一周前突发黄疸，症见面目悉黄，胸肋胀痛，恶心呕吐，小便黄赤，证属肝胆湿热，宜选用的成药是茵栀黄口服液（E对）。茵栀黄口服液：【主治】肝胆湿热所致的黄疸，症见面目悉黄、胸胁胀痛、恶心呕吐、小便黄赤；急、慢性肝炎见上述证候者。香连丸（A错）：【主治】大肠湿热所致的痢疾，症见大便脓血、里急后重、发热腹痛；肠炎、细菌性痢疾见上述证候者。排石颗粒（B错）：【主治】下焦湿热所致的石淋，症见腰腹疼痛、排尿不畅或伴有血尿；泌尿系统结石见上述证候者。消炎利胆片（C错）：【主治】肝胆湿热所致的胁痛、口苦；急性胆囊炎、胆管炎见上述证候者。沉香化滞丸（D错）的主治，2022年考试指南未明确说明。沉香化滞丸：【主治】用于饮食停滞，胸腹胀满。